根据沉降公式（Stock's方程）计算所得的直径称为
A. 定方向径
B. 等价径
C. 体积等价径
D. 有效径
E. 筛分径

正确答案：D。有效径